含有甲磺酸酯结构的抗肿瘤药物白消安，在体内的Ⅱ相代谢反应是
A. 甲基化结合反应
B. 与硫酸的结合反应
C. 与谷胱甘肽的结合反应
D. 与葡萄糖醛酸的结合反应
E. 与氨基酸的结合反应

正确答案：C。与谷胱甘肽的结合反应

解析：本题考查药物化学结构与第Ⅱ相生物转化的规律。含有甲磺酸酯结构的抗肿瘤药物白消安，在体内的Ⅱ相代谢反应是与谷胱甘肽的结合反应（C对）。第Ⅱ相生物转化反应包括：1.与葡萄糖醛酸的结合反应、2.与硫酸的结合反应、3.与氨基酸的结合反应、4.与谷胱甘肽的结合反应、5.乙酰化结合反应、6.甲基化结合反应。白消安体内代谢途径：甲磺酸酯和巯基生成硫醚结合物，再和另一个甲磺酸酯成环生成氢化噻吩，此过程属于与谷胱甘肽的结合反应；甲基化结合反应（A错）是药物分子结合甲基，如肾上腺素的甲基化反应；与硫酸的结合反应（B错）是药物分子与硫酸结合，如支气管扩张药沙丁胺醇，与硫酸结合形成硫酸酯化结合物；与葡萄糖醛酸的结合反应（D错）是药物分子与葡萄糖醛酸结合，如对乙酰氨基酚；与氨基酸的结合反应（E错）是羧酸类药物和代谢物的主要结合反应，如苯甲酸和水杨酸结合生成马尿酸和水杨酰甘氨酸。